萆薢除利湿浊外，又能
A. 破血通经
B. 通气下乳
C. 清肺止咳
D. 杀虫止痒
E. 祛风湿

正确答案：E。祛风湿